非处方药广告宣传的主要对象是
A. 医师
B. 药厂
C. 药品经营部门
D. 医院药房
E. 消费者

正确答案：E。消费者